房间隔缺损杂音产生的主要原理是
A. 主动脉瓣相对狭窄
B. 血流直接通过缺损口
C. 二尖瓣相对狭窄
D. 肺动脉瓣相对狭窄
E. 三尖瓣相对狭窄

正确答案：D。肺动脉瓣相对狭窄

解析：房间隔缺损，是左右心房间的间隔出现漏口，胎儿出生后，体循环压力大于肺循环压力，左心房压高于右心房，房间隔缺损时会出现左向右分流，收缩期因心脏收缩，通过肺动脉瓣的血流量增多、速度加快，造成肺动脉瓣相对缩窄（D对），而在左胸骨旁第2肋间可闻及2~3级喷射性收缩期杂音。